女，47岁，已经诊断为左下第一磨牙Ⅲ度根分叉病变，松（-），则一般不采用
A. 引导组织再生术
B. 分根术
C. 隧道成形术
D. 袋壁切除术
E. 根向复位瓣术

正确答案：A。引导组织再生术

解析：本题考查Ⅲ度根分叉病变的治疗。女，47岁，已经诊断为左下第一磨牙Ⅲ度根分叉病变，松（-），则一般不采用引导组织再生术（A错，为本题的正确答案）。Ⅱ度根分叉病变为引导组织再生术的适应证。Ⅲ度和Ⅳ度病变：治疗目的是使根分叉区充分暴露，以利于菌斑控制。颊侧的深牙周袋若有足够宽的附着龈，可行袋壁切除术（D对）；若附着龈较窄，则应行翻瓣术，在刮净根面及修整骨缺损后，将龈瓣根向复位（E对）并缝合于牙槽嵴水平，下颌牙的舌侧一般可切除袋壁。①若多根牙仅有一个根病变较重，有深牙周袋和骨吸收，另外1或2个根病情较轻，且患牙尚不太松动，则可在翻瓣术中将该患根截除，使分叉区充分暴露，余留的牙根得以彻底清洁，该处的深牙周袋也可消除。截根术对于上颌磨牙颊根的病变效果较佳。②下颌磨牙当根分叉区病变较重而近、远中根分别还有一定的支持组织时，也可用分根术（B对），将患牙分割为近中和远中两个“单根牙”。然后分别做冠或做联冠修复，可取得较好的治疗效果。③若某一根病变已严重，另一根尚好，则可行牙半切除术，将严重的一半连冠带根一起摘除，保留另一半侧。隧道成形术（C对）即做牙成形术，磨除牙颈部牙冠过突出和釉质突起，或在根柱较短的下颌磨牙根分叉处磨除部分牙体组织，以扩大根分叉开口处；根向复位瓣术适用于牙周袋超过膜龈联合以及因根分叉病变需暴露根分叉而角化龈过窄者。